反映血型为AB型的人在人群中所占的比例，宜计算
A. 率
B. 标准化率
C. 构成比
D. 相对比
E. 绝对数

正确答案：C。构成比

解析：本题考查构成比（1）率是指在单位时间内某一确定人群中某现象发生的频率或强度，是某时期内某现象实际发生例数与可能发生该现象的总例数之比，即：率=单位时间内某现象实际发生的例数/可能发生该现象的总人数×k（k=100%，1000‰，10000/万，100000/10万）。（2）标准化率是流行病学中常见的一个指标，当几个比较组之间的年龄、性别等变量的构成不同时，此时直接比较组间的粗率容易导致偏倚，通常需要对率做标准化后再比较。（3)构成比就是表示某事件或事物中各部分在这个整体中所占的比重，一般为百分比的形式，具体计算公式就是：构成比=（所求的组成部分的量/整体全部的量）X100% 。(4）比：也称相对比，指两个数相除的值，说明两者的相对水平，即：比=甲指标/乙指标。（5）统计中常用的总量指标就是绝对数。它是反映客观现象总体在一定时间、地点条件下的总规模、总水平的综合指标。